关于选择偏倚的描述，正确的是
A. 增大样本量可以减小选择偏倚
B. 选人群病例和人群对照更容易发生选择偏倚
C. 以医院为基础的病例对照研究不容易发生选择偏倚
D. 如果病例和对照均来自同一医院，可以避免选择偏倚
E. 病例对照研究比队列研究更容易发生选择偏倚

正确答案：E。病例对照研究比队列研究更容易发生选择偏倚

解析：本题考查选择偏倚的相关内容。一项病例对照研究所选择的研究对象只是源人群的一个样本，由于选入的研究对象与未选入者在某些特征上存在差异而引起的系统误差称为选择偏倚。病例对照研究比队列研究更容易发生选择偏倚（E对ABCD错），一项病例对照研究所选择的研究对象只是源人群的一个样本，由于选入的研究对象与未选入者在某些特征上存在差异而引起的系统误差。但队列研究也有可能发生选择偏倚，例如志愿参加、已患但潜隐的疾病而在开始研究时未被察觉，回顾性队列研究的一些对象的记录缺失或不完整等，都是偏倚的来源。